女性，28岁。停经55天，伴恶心呕吐，妇科检查：子宫增大约妊娠50天，双侧附件（-）。若确定为妊娠，应选择最佳的终止妊娠方法是
A. 药物流产
B. 人工流产吸宫术
C. 人工流产钳刮术
D. 乳酸依沙吖啶引产
E. 缩宫素静脉滴注

正确答案：B。人工流产吸宫术

解析：该孕妇停经55天（10周内），子宫增大程度与停经周数相符，确诊早期妊娠，无其他禁忌证，最佳的终止妊娠方法是人工流产吸宫术（B对）。当孕周≥10周的早期妊娠应采取人工流产钳刮术（P383）（C错）。药物流产（P384）（A错）用于妊娠≤49日，本人自愿、年龄小于40岁的健康妇女。乳酸依沙吡啶引产（第2版实用妇产科学P1026）（D错）适用于14～27周，要求终止妊娠而无禁忌证者。缩宫素静脉滴注（P189）（E错）适用于协调性宫缩乏力的孕妇。